一类精神药品处方应保留
A. 1年
B. 2年
C. 3年
D. 4年
E. 5年

正确答案：C。3年